妇科十味片具有养血舒肝、调经止痛的功能。处方组成：醋香附500g、川芎20g、当归180g、醋延胡索40g、白术29g、甘草14g、大枣100g、白芍15g、赤芍15g、熟地黄60g、碳酸钙65g。以上十一味，当归126g、醋香附、醋延胡索、白芍、赤芍、碳酸钙粉碎成细粉，甘草、大枣加水煎煮三次，合并煎液，滤过；剩余当归与白术、熟地黄、川芎用70%乙醇加热回流二次，滤过，合并二次滤液，回收乙醇。将以上两种滤液合并，减压浓缩为稠膏，加入上述醋香附等六味细粉，混匀，干燥，粉碎成细粉，用糖浆与淀粉糊制成颗粒，干燥压制成3000片，包薄膜衣，即得。关于处方中醋香附炮制方法和作用的说法，错误的是
A. 香附醋制后味苦、涩，性温，多用于治妇女崩漏不止
B. 香附醋制后专入肝经，疏肝止痛作用增强
C. 香附醋制时，每100kg香附颗粒或片，用米醋20kg
D. 可用香附颗粒加米醋拌匀，闷润至醋被吸尽，文火炒干
E. 香附醋制时，可用香附加定量米醋和水，煮至醋液基本吸尽，再蒸5小时，闷片刻，取出微晾，切薄片，干燥

正确答案：A。香附醋制后味苦、涩，性温，多用于治妇女崩漏不止

解析：本题考查香附的炮制作用和炮制方法。下列关于醋香附的说法，错误的是香附醋制后味苦、涩，性温，多用于治妇女崩漏不止（A错，为本题正确答案）。香附【炮制作用】生香附味辛、微苦、微甘，性平。归肝、脾、三焦经。具有疏肝解郁，理气宽中，调经止痛的功能。用于肝郁气滞，胸胁胀痛，疝气疼痛，乳房胀痛，脾胃气滞，脘腹痞闷，胀满疼痛，月经不调，经闹痛经。①生品多入解表剂中，以理气解郁为主。②醋香附专入肝经，疏肝止痛作用增强（B对），并能消积化滞。③四制香附以行气解郁，调经散结为主，多用于治疗胁痛，痛经，月经不调等。④酒香附能通经脉，散结滞，多用于治寒疝腹痛。⑤香附炭味苦、涩、性温，多用于治妇女崩漏不止等。【炮制方法】处方用名有香附、炙香附、醋香附、四制香附、酒香附、香附炭。①香附：取原药材，除去毛须及杂质，碾成绿豆大颗粒，或润透，切薄片，干燥，筛去碎屑。②醋香附：a.取净香附颗粒或片，加定量的米醋拌匀，闷润至醋被吸尽后，置炒制容器内，用文火加热炒干，取出晾凉（D对）。筛去碎屑。每100kg香附颗粒或片，用米醋20kg。b.取净香附：加入定量的米醋，再加与米醋等量的水。共煮至醋液基本吸尽，再蒸5小时，闷片刻，取出微晾，切薄片，干燥（E对），筛去碎屑；或取出干燥后，碾成绿豆大颗粒。每100kg香附颗粒或片，用米醋20kg（C对）。